患者，男，35岁。左腰部受伤后出现腰痛。体检：血压125/90mmHg，P80次/分，左肾区叩痛，腹膜刺激征（-）；尿常规检查：RBC5～10个/HP。该患者最可能的诊断是
A. 肾部分裂伤
B. 肾全层裂伤
C. 肾蒂损伤
D. 肾挫伤
E. 自发性肾破裂

正确答案：D。肾挫伤

解析：青年男性患者，左腰部受伤后出现腰痛（提示可能有肾脏损伤），血压125/90mmHg（正常值90～140/60～90mmHg），P80次/分（正常值60～100次/分），腹膜刺激征（-）（提示患者损伤较轻），左肾区叩痛，尿常规检查：RBC5～10个/HP（高于正常值0～3个/HP，提示肾损伤），结合患者病史、临床表现和相关检查，该患者最可能的诊断为左肾挫伤（D对）。肾部分裂伤（A错）和肾全层裂伤（B错）损伤较严重，会出现明显血尿、腰腹部可触及肿块，还可因尿液外渗而致腹膜刺激症阳性。因肾蒂包含肾动静脉、输尿管等重要结构，肾蒂损伤（C错）可迅速出现血尿、休克等表现，病情危急。自发性肾破裂（E错）是指在无创伤情况下发生的肾实质、肾盂或肾血管破裂，多在病理性肾的基础上发生，主要表现为疼痛、腹部包块和血尿。